与人的语言、呼吸和心脏的搏动关系密切的是
A. 卫气
B. 元气
C. 中气
D. 宗气
E. 营气

正确答案：D。宗气

解析：宗气上走息道，推动肺的呼吸，因此，凡是呼吸、语言、发声皆与宗气有关，宗气贯注于心脉之中，促进心脏推动血液运行，因此，凡是血液的运行，心搏的力量和节律等皆与宗气有关。（D对）。卫气（A错）具有防御外邪、温养全身和调控腠理的生理功能。元气（B错）具有推动和调节人体的生长发育和生殖机能，推动和调控各脏腑、经络、形体、官窍的生理活动的功能。中气（C错）是脾胃二气的合称，是升降协调的冲和之气。营气（E错）具有化生血液和营养全身的功能。